采用固定桥修复时，确定基牙数目的影响因素是
A. 基牙牙根情况
B. 基牙牙槽骨情况
C. 基牙牙周膜情况
D. 咬合情况
E. 以上都是

正确答案：E。以上都是

解析：本题考查确定基牙数目的影响因素。基牙是固定桥的基础，及主要功能是支持固定桥，因此基牙的支持与固位作用应从基牙的数目（依据Ante法则选择基牙数目，Ante法则：固定局部义齿基牙牙周膜面积的总和应等于或大于缺失牙牙周膜面积的总和）（C对）、冠根比、根的外形与结构（A对）、骨高度降低程度（B对）。基牙为整个固定桥提供固位力，基牙的选择应使整个固定桥能承受足够的咬合力，不至于折断脱落（D对）。（ABCD均对，故E为本题的正确答案）。